男，62岁。上腹部隐痛1年，进食后呕吐20天，呕吐物含有宿食。查体：贫血貌，消瘦，上腹部可见胃型，可闻及振水音。患者最早可能出现的酸碱失衡和电解质紊乱的类型是
A. 低氯血症、代谢性酸中毒
B. 低钾血症、代谢性酸中毒
C. 高钾血症、代谢性碱中毒
D. 高钾血症、代谢性酸中毒
E. 低钾血症、代谢性碱中毒

正确答案：E。低钾血症、代谢性碱中毒